《中国药典》规定氨茶碱为白色至微黄色的颗粒或粉末，易结块；在空气中吸收二氧化碳，并分解成茶碱。根据氨茶碱的性状，其贮存的条件应满足
A. 遮光，密闭，室温保存
B. 遮光，密封，室温保存
C. 遮光，密闭，阴凉处保存
D. 遮光，严封，阴凉处保存
E. 遮光，熔封，冷处保存

正确答案：B。遮光，密封，室温保存

解析：本题考查氨茶碱的贮存条件。《中国药典》规定氨茶碱为白色至微黄色的颗粒或粉末，易结块；在空气中吸收二氧化碳，并分解成茶碱。根据氨茶碱的性状，其贮存的条件应满足遮光，密封，室温保存（B对）。氨茶碱为白色粉末，易结块，在空气中吸收二氧化碳并分解成茶碱，易受光线湿度的影响而变质，《中国药典》规定其贮存条件为遮光密封保存。